按十二经脉气血流注次序，足厥阴肝经上接
A. 手太阴肺经
B. 足少阳胆经
C. 手少阳三焦经
D. 手厥阴心包经
E. 手少阴心经

正确答案：B。足少阳胆经

解析：足厥阴肝经上接足少阳胆经（B对）。手太阴肺经上接足厥阴肝经（A错）。手少阳三焦经上接手厥阴心包经（C错）。手厥阴心包经上接足少阴肾经（D错）。手少阴心经上接足太阴脾经（E错）。十二经脉交接次序顺口溜：肺大胃脾心小肠，膀肾包焦胆肝详。